可使肥厚性心肌病杂音减轻的药物是
A. 美托洛尔
B. 呋塞米
C. 多巴胺
D. 地高辛
E. 硝酸甘油

正确答案：A。美托洛尔

解析：当肥厚型心肌病伴有流出道梗阻时，可在胸骨左缘第3～4肋间闻及较粗糙的喷射性收缩期杂音。若减弱心肌收缩力或增加心脏后负荷，使射血速度减慢，心脏杂音可减轻或消失。如美托洛尔（A对）为β受体拮抗剂，对心肌有负性肌力的作用，可减弱心肌收缩力而使肥厚型心肌病杂音减轻。呋塞米（B错）和硝酸甘油（E错）可减轻心脏后负荷而使肥厚型心肌病杂音增强；而多巴胺（C错）和地高辛（D错）均为正性肌力药物，可增加心肌收缩力而使肥厚型心肌病杂音增强。